男，45岁。发作性头痛、心悸、大汗2年，发作时血压230/130mmHg，平素血压不高。对诊断最有帮助的是发作时测定尿
A. 17-羟皮质类固醇
B. 醛固酮
C. 17-酮类固醇
D. 游离皮质醇
E. 儿茶酚胺

正确答案：E。儿茶酚胺

解析：中年男性患者，发作性头痛、心悸、大汗2年（嗜铬细胞瘤诊断意义的三联征），平素血压不高，发作时血压230/130mmHg（提示为型嗜铬细胞瘤阵发性高血压型）。据患者典型临床表现，该患者最可能的诊断是嗜铬细胞瘤。阵发性者以发作后儿茶酚胺明显升高为特征性变化，故测定发作后血或尿儿茶酚胺对诊断最有帮助（E对）。测定尿17-羟皮质类固醇（A错）、17-酮类固醇（C错）、游离皮质醇（D错）对诊断库欣综合征最有帮助。